患者，男，60岁。脑溢血后长期卧床，2天前出现发热，咳嗽、呼吸困难等症状，胸透见两肺下叶有多数散在边缘不清小灶阴影。应首先考虑的是
A. 大叶性肺炎
B. 干酪样肺炎
C. 间质性肺炎
D. 转移性肿瘤
E. 小叶性肺炎

正确答案：E。小叶性肺炎

解析：小叶性肺炎（E对）即支气管性肺炎，指病原体经支气管入侵，引起细支气管、终末细支气管及肺泡的炎症，常继发于其他疾病，如支气管炎、支气管扩张、上呼吸道病毒感染以及长期卧床的危重患者，X线影像显示为沿着肺纹理分布的不规则斑片状阴影，边缘密度浅而模糊，无实变征象，肺下叶常受累。该患者系老年男性，脑溢血后长期卧床符合小叶性肺炎的起病因素，胸透见两肺下叶有多数散在边缘不清小灶阴影符合小叶性肺炎的X线征象。大叶性肺炎（A错）的典型表现为肺实质炎症，通常不累及支气管，X线影像显示肺叶或肺段的实变阴影。干酪样肺炎（P67）（B错）属于继发性肺结核，多发生在机体免疫力和体质衰弱，又受到大量结核分枝杆菌感染的患者，X线影像呈大叶性密度均匀磨玻璃状阴影。间质性肺炎（C错）是以肺间质为主的炎症，累及支气管壁和支气管周围组织，呼吸道症状较轻，X线影像表现为一侧或双侧肺下部不规则阴影，可呈磨玻璃状、网格状，其间可有小片肺不张阴影。转移性肿瘤（D错）常伴有咳嗽、痰中带血丝、胸痛、胸闷、气急等症状。